男孩，14岁，进行性开口困难7年，面部明显不对称。临床检查已完全不能张口。5岁时曾发生颏部对冲性损伤。面部不对称可具体表现为
A. 健侧面部丰满
B. 患侧面部狭长
C. 前牙反（牙合）
D. 颏点偏向患侧
E. 颏点偏向健侧

正确答案：D。颏点偏向患侧

解析：单侧颞下颌关节强直，面部发生严重的不对称畸形，主要表现为患侧面部丰满，颏点偏向患侧；双侧病变则表现为严重的小下颌畸形。掌握“颞下颌关节强直”知识点。